短时间接触容许浓度指一个工作日内，任何一次接触不得超过的（）时间加权平均的容许接触水平
A. 5分钟
B. 10分钟
C. 15分钟
D. 20分钟
E. 30分钟

正确答案：C。15分钟